男，10岁。因发热7天，抗生素治疗无效入院，查体：球结膜充血，口唇皲裂，杨梅舌，颈部淋巴结肿大，全身可见多形性红斑。临床治愈出院后2个月猝死于家中，其最可能的死因是
A. 心肌炎
B. 脑栓塞
C. 脑出血
D. 心包炎
E. 冠状动脉瘤破裂

正确答案：E。冠状动脉瘤破裂

解析：小儿患者。发热7天，抗生素治疗无效入院（川崎病发热持续7～14天或更长，抗生素治疗无效），查体：球结膜充血，口唇皲裂，杨梅舌，颈部淋巴结肿大，全身可见多形性红斑（川崎病典型表现）。结合患者病史、症状可诊断为川崎病。临床治愈出院后2个月猝死于家中，其最可能的死因是冠状动脉瘤破裂（E对）。川崎病为自限性疾病，多数预后良好。部分患者发生冠状动脉瘤，可导致猝死。心肌炎（A错）多有病毒感染史，起病隐匿，有乏力、活动受限、心悸、胸痛等症状，少数患者可发生心力衰竭并发严重心律失常、心源性休克，死亡率高。脑栓塞（B错）多有风湿性心脏病、心房颤动、或大动脉粥样硬化等病史，起病急骤，表现三偏征及颅内高压。脑出血（C错）多有高血压及动脉硬化病史，突发意识障碍及偏瘫。心包炎（D错）多于感染症状出现10～20天后有胸痛等症状，部分患者可伴有肺炎和胸膜炎临床表现。